下列关于硝苯地平的叙述哪项是错误的
A. 阻滞钙内流降低心肌细胞钙浓度
B. 对心肌有轻度的抑制作用
C. 对外周动脉扩张作用强
D. 用于治疗房室传导阻滞
E. 不良反应轻微

正确答案：D。用于治疗房室传导阻滞